某药物体内过程符合药物动力学单室模型药物，消除按一级速率过程进行，静脉注射给药后进行血药浓度监测，1h和4h时血药浓度分别为100mg/L和12.5mg/L，则该药静脉注射给药后3h时的血药浓度是
A. 75mg/L
B. 50mg/L
C. 25mg/L
D. 20mg/L
E. 15mg/L

正确答案：C。25mg/L

解析：本题考查单室模型静脉注射血药浓度与时间的关系。根据公式lgC=（-k/2.303）t+lgC₀，将t=1，C=100；t=4，C=12.5分别代入公式，可得到斜率b=-0.3，截距a=2.3，则lgC=-0.3t+2.3，题目需要求3h血药浓度，于是将t=3带入lgC=-0.3t+2.3，可得到C=25mg/L（C对）。